下列哪种过程与K+的跨膜扩散无关
A. 快反应细胞的静息电位
B. 慢反应细胞动作电位的0期去极
C. 快反应细胞动作电位的1期复极
D. 快反应细胞动作电位的3期复极
E. 慢反应自律细胞的4期自动去极

正确答案：B。慢反应细胞动作电位的0期去极